仙鹤草可杀
A. 蛔虫
B. 蛲虫
C. 绦虫
D. 钩虫
E. 阴道滴虫

正确答案：E。阴道滴虫

解析：本题考查的是仙鹤草的主治病证。仙鹤草可杀阴道滴虫（E对）。仙鹤草：【主治病证】（1）咳血，衄血，吐血，尿血，便血，崩漏。（2）久泻，久痢。（3）疟疾，痈肿疮毒。（4）滴虫阴道炎所致的阴痒、带下。（5）脱力劳伤。槟榔：【主治病证】（1）绦虫病（C错），姜片虫病，蛔虫病（A错），蛲虫病（B错），钩虫病等（D错）。（2）食积气滞之腹胀、便秘，泻痢里急后重。（3）水肿，脚气浮肿。（4）疟疾。